男孩，1岁。因身材矮小、智能发育迟缓就诊。查体：身长63cm，表悄呆滞，四肢肌张力低下，眼距宽，鼻梁低平，眼外眦上斜，四肢短，手指短，小指内弯。对明确诊断最有意义的检查是
A. 血T₃、T₄、TSH测定
B. 染色体核型分析
C. 尿三氯化铁试验
D. 血钙、磷、碱性磷酸酶检测
E. 血氨基酸分析

正确答案：B。染色体核型分析

解析：男性幼儿患者，临床表现为智能落后、特殊面容和生长发育迟缓，综合患者的症状、体征和辅助检查，初步诊断为唐氏综合征，对明确诊断最有意义的检查是染色体核型分析（B对）。血T₃、T₄、TSH测定（A错）适用于诊断先天性甲状腺功能减退症。尿三氯化铁试验（C错）适用于诊断苯丙酮尿症。血钙、磷、碱性磷酸酶检测（D错）适用于诊断佝偻病。血氨基酸分析（E错）适用于氨基酸相关疾病的诊断，如白化病等。